治疗不稳定型心绞痛不恰当的措施是
A. 静脉滴注尿激酶
B. 皮下注射低分子肝素
C. 口服阿司匹林
D. 口服阿托伐他汀
E. 静脉湍注硝酸异山梨酯

正确答案：A。静脉滴注尿激酶

解析：不稳定型心绞痛是以动脉粥样硬化不稳定斑块破裂或糜烂导致冠状动脉内急性血栓形成为主要病理变化的疾病。治疗以缓解即刻缺血和预防严重不良反应后果为原则，包括1.抗缺血治疗以达到降低心肌氧耗和增强灌注，缓解心绞痛的目的，如静脉注硝酸异山梨酯（E对）、服用β受体拮抗剂、钙通道阻滞剂；2.抗血栓治疗：包括（1）抗血小板治疗：阿司匹林（C对）是抗血小板治疗的基石；（2）抗凝治疗：在抗血小板的基础上静脉注射普通肝素、或皮下注射低分子量肝素等；3.调脂治疗：如口服阿托伐他汀（D对）；4.ACEI或ARB降低远期心血管发生事件；4.根据危险度分层进行的有创治疗。静脉滴注尿激酶（A错，为本题正确选项）用于急性ST段抬高型心肌梗死的溶栓治疗。